复方羟考酮（羟考酮不超过5mg）属于
A. 含特殊药品的复方制剂
B. 第一类精神药物
C. 第二类精神药物
D. 医疗用毒性药品

正确答案：C。第二类精神药物

解析：本题考查精神药品管理。口服固体制剂每剂量单位含羟考酮碱不超过5毫克，且不含其他麻醉药品、精神药品或药品类易制毒化学品的复方制剂列入第二类精神药品管理（C对）。